王某，男性，6岁。1个月前出现眼睑水肿，尿常规检查为蛋白尿，24小时定量为4.5g，血浆总蛋白为25g/L，B超提示腹水。其诊断是
A. 急性肾炎
B. 慢性肾炎
C. 肾病综合征
D. 肝硬化腹水
E. 以上均不是

正确答案：C。肾病综合征

解析：肾病综合征的临床特征为：①大量蛋白尿（≥3.5g/d）。②低白蛋白血症（小于或等于30g/L）。③水肿。④高脂血症。其中“大量蛋白尿”和“低白蛋白血症”为诊断NS的必备条件。根据本病患者1个月前出现眼睑水肿。实验室检查：尿常规检查是蛋白尿，24小时定量为4.5g，血浆总蛋白为25g/L（小于30g/L），影像学检查：B超提示腹水，可诊断为肾病综合征（C对E错）。几乎全部急性肾炎患者均有起病首发症状肾小球源性血尿，多数患者会出现一过性轻、中度高血压（A错）。慢性肾炎以蛋白尿、血尿、高血压、水肿为基本临床表现。起病方式各有不同，病情迁延，病变缓慢进展，可有不同程度的肾功能减退，最终将发展为慢性肾衰竭的一组肾小球病（B错）。肝硬化腹水的主要症状是腹胀，常常是由于腹围增大才发现腹水，可伴有足背水肿。其他常见症状有乏力、食欲缺乏以及营养状况差（D错）。